适用于热结肠燥便秘的方剂是
A. 黄连解毒汤或仙方活命饮加减
B. 大承气汤或麻仁滋脾丸加减
C. 八珍汤或十全大补汤加减
D. 萆薢渗湿汤或龙胆泻肝汤加减
E. 凉血地黄汤或槐角丸加减

正确答案：B。大承气汤或麻仁滋脾丸加减

解析：大承气汤或麻仁滋脾丸均可治疗热结肠燥之大便不通，频转矢气，脘腹痞满，腹痛拒按，按之则硬，甚或潮热谵语，手足濈然汗出，舌苔黄燥起刺，或焦黑燥裂，脉沉实（B对）。黄连解毒汤或仙方活命饮加减主要治疗大热烦躁，口燥咽干，错语不眠；或热病吐血、衄血；或热甚发斑，或身热下利，或湿热黄疸等病症（A错）；八珍汤或十全大补汤加减主治气血两虚证。症见面色苍白或萎黄，头晕耳眩，四肢倦怠，气短懒言，心悸怔忡，饮食减少，舌淡苔薄白，脉细弱或虚大无力（C错）。萆薢渗湿汤或龙胆泻肝汤均属于清利湿热的方剂，具有清脏腑热，清泻肝胆实火，清利肝经湿热之功效。主治肝胆实火上炎证。头痛目赤，胁痛，口苦，耳聋，耳肿，舌红苔黄，脉弦细有力（D错）。凉血地黄汤具有清热解毒，凉血止血的功效。治疗胃火炽盛、吐血、衄血以及咳血、便血或蓄血，以及阳毒发斑等症；槐角丸具有清肠疏风、凉血止血的功效，可用于血热所致的肠风便血、痔疮肿痛（E错）。